《执业医师法》规定，医师在执业活动中应履行的义务之一是
A. 在注册的执业范围内，选择合理的医疗预防保健方案
B. 从事医学研究学术交流，参加专业学术团体
C. 参加专业培训，接受继续医学教育
D. 努力钻研业务，更新知识，提高专业水平
E. 获得工资报酬和津贴，享受国家规定的福利待遇

正确答案：D。努力钻研业务，更新知识，提高专业水平

解析：《执业医师法》规定，医师在执业活动中应当履行下列义务：①遵守法律、法规，遵守技术操作规范；②树立敬业精神，遵守职业道德，履行医师职责，尽职尽责为患者服务；③关心、爱护、尊重患者，保护患者的隐私；④努力钻研业务，更新知识，提高专业技术水平（D对）；⑤宣传卫生保健知识，对患者进行健康教育。在注册的执业范围内，选择合理的医疗预防保健方案（A错）、从事医学研究学术交流，参加专业学术团体（B错）、参加专业培训，接受继续医学教育（C错）和获得工资报酬和津贴，享受国家规定的福利待遇（E错）均属于医师在执业活动中享受的权利。